男，35岁。吸烟10年，每天1包烟，不想戒烟。他说：“就算生病我也不会把烟戒掉。”属于下列哪个阶段模式
A. 行动阶段
B. 准备阶段
C. 打算转变阶段
D. 维持阶段
E. 无打算阶段

正确答案：E。无打算阶段

解析：行为转变理论模式，也称为行为阶段转变理论模型（TTM） ，它着眼于行为变化过程及对象需求，理论基础是社会心理学。它认为人的行为转变是一个复杂、渐进、连续的过程，可分为5个不同的阶段，即没有准备阶段、犹豫不决阶段、准备阶段、行动阶段和维持阶段。在无打算阶段（E对），患者对问题尚无了解，没有形成意图，因此应该采取的措施是，提供信息，提高认识，使患者形成解决问题的意图，从而促使行为改变。